对疑似甲类传染病患者在明确诊断前，应在指定的场所进行
A. 医学观察
B. 留验
C. 隔离
D. 访视
E. 就地诊验

正确答案：C。隔离